运动员参赛时非禁用的药是
A. 利尿药
B. 合成类固醇
C. 钙离子通道阻滞剂
D. 麻醉性镇痛剂
E. β受体阻断剂

正确答案：C。钙离子通道阻滞剂

解析：本题考查运动员禁用药。运动员参赛时非禁用的药是钙离子通道阻滞剂（C对）。运动员禁用的药物包括六类：①精神刺激剂，如麻黄碱、可卡因等；②合成类固醇，如甲睾酮、苯丙酸诺龙等；③利尿剂，如呋塞米、螺内酯等；④麻醉镇痛剂，如可待因、芬太尼等；⑤B受体阻断剂，如普萘洛尔等；⑥肽激素类，如人生长激素、促性腺激素等。